土壤环境背景值是指
A. 土壤中各种元素的含量
B. 任何一处土壤中各种元素的含量
C. 该地区未受或少受人类活动影响的土壤环境本身的各种化学元素组成及其含量
D. 土壤中某种元素的含量
E. 土壤表层中各种元素的含量

正确答案：C。该地区未受或少受人类活动影响的土壤环境本身的各种化学元素组成及其含量

解析：本题考查土壤环境背景值。土壤环境背景值是指该地区未受或少受人类活动（特别是人为污染）影响的土壤环境本身的各种化学元素组成及其含量（C对ABDE错）。它是一个相对的概念，只能表示在相对不受污染情况下，环境要素的基本化学组成。同一环境要素在不同的地理、地质环境中，自然背景值是不同的。化学元素含量超过了环境背景值和能量分布异常，表明环境可能受到了污染。